四逆汤所治厥逆的机理是
A. 阳气内郁不达四末
B. 肝郁气滞
C. 心肾阳衰
D. 元气大亏阳气暴脱
E. 血虚寒凝经脉

正确答案：C。心肾阳衰

解析：四逆汤方中生附子大辛大热，入心、脾、肾经，温壮心肾之阳，回阳破阴以救逆，为君药；臣以辛热之干姜，入心、脾、肺经，既与附子相须为用，以增温里回阳之力；又温中散寒，助阳通脉。炙甘草一药三用：一以益气补中，与姜附温补结合，治虚寒之本；二以甘缓姜附峻烈之性，使其破阴回阳而无暴散之虞；三以调和药性，并使药力持久，是为佐药而兼使药之用。三药合用，大辛大热，使阳复厥回（C对）。